流行性腮腺炎邪陷心肝变证的治法为
A. 清热解毒，软坚散结
B. 疏风清热，散结消肿
C. 清肝泻火，活血止痛
D. 清热解毒，息风开窍
E. 清热凉血散瘀

正确答案：D。清热解毒，息风开窍

解析：该题主要考查小儿流行性腮腺炎邪陷心肝变证的治法以及与其他证型的鉴别。流行性腮腺炎邪陷心肝变证的治法清热解毒，息风开窍（D对）。清热解毒，软坚散结为热毒壅盛治法（A错）。疏风清热，散结消肿为邪犯少阳治法（B错）。清肝泻火，活血止痛为毒窜睾腹治法（C错）。流行性腮腺炎治法中无清热凉血散瘀（E错）。